智商IQ的结果“高于平常”，是指其分数为
A. 70~79
B. 80~89
C. 90~109
D. 110~119
E. 120~129

正确答案：D。110~119